在《中国药典》中维生素B₁片含量的测定
A. 气相色谱法
B. 碘量法
C. 微生物法
D. 紫外分光光度法
E. 非水溶液滴定法

正确答案：D。紫外分光光度法

解析：本题考查维生素B₁片的含量测定。中国药典用紫外分光光度法（D对）测定维生素B₁片的含量。原理：维生素B₁分子中具有共轭双键结构，在紫外区有吸收，根据其最大吸收波长处的吸光度即可计算含量。维生素B₁片剂和注射液均采用本法测定。